某单侧采光住宅进深为7m，地板至窗上缘的高度为2m，若要使其符合采光卫生要求，该居室进深应至少减少
A. 0.5m
B. 1.0m
C. 1.5m
D. 2.0m
E. 2.5m

正确答案：D。2.0m

解析：本题考查居室进深。居室进深与采光有关，一般以室深系数表示。室深系数是居室进深与地板至窗上缘高度之比。卫生上要求单侧采光的室深系数不应超过2.0～2.5米，照此推算该室目前的室深系数是3.5米，这样至少减少1米（D对ABCE错），才能符合卫生要求。